对躯体疾病所致谵妄状态的处理不正确的方法是
A. 积极治疗原发疾病
B. 精神症状对症处理
C. 加强护理与支持治疗
D. 环境干预，越安静越好
E. 告知家属相关知识，消除紧张情绪

正确答案：D。环境干预，越安静越好

解析：躯体疾病所致谵妄状态的处理原则：（1）安静的环境和良好的护理，环境干预与安静程度无关（D错，为本题正确答案）；（2）积极治疗原发疾病（A对）；（3）精神症状给予对症治疗（B对）；（4）加强营养支持治疗（C对），全程心理治疗；（5）需要对家属进行必要的相关知识教育，以消除其紧张情绪，以便更好地护理病人（E对）。